游离皮瓣移植的注意事项错误是
A. 尽量缩短组织瓣的缺血时间
B. 血管外膜可植入吻合口
C. 应有足够长的血管蒂
D. 吻合后的血管应无张力
E. 供区和受植区的血管口径尽可能相近

正确答案：B。血管外膜可植入吻合口

解析：游离皮瓣①必须严格选择适应证，相对来说，此种手术比带蒂皮瓣技术要求高，难度大。如为肿瘤术后缺损立即整复，应要求患者全身情况能耐受。②术者必须熟练地掌握小血管吻合技术，熟练的手术技巧和高度的负责精神是手术成败的关键。③选择供区时除考虑色泽、质地、厚度与受区近似外，还要考虑尽量避免造成供区的继发畸形或功能障碍。④供区的血管口径和受植区的血管口径应尽可能相近，以保证手术成功。⑤应尽量缩短组织瓣的缺血时间，一般在受区条件准备好后再行断蒂，血管吻合应力争一次成功。⑥应有足够长的血管蒂。由于移植到口腔颌面部的组织瓣与血管蒂多不在一个平面上，血管带的长度应足够，至少应在5cm以上，有时甚至更长，才能保证吻合后无张力。掌握“皮瓣移植”知识点。